癫痫小发作选用
A. 乙琥胺
B. 苯妥英钠
C. 丙戊酸钠
D. 苯巴比妥
E. 卡马西平

正确答案：A。乙琥胺

解析：本题考查癫痫的治疗药物选择。乙琥胺（A对）为临床治疗癫痫小发作的首选药。